某男,60岁。患慢性肠炎数年，症见腹痛绵绵、大便清稀或有黏液及黏液血便、食少腹胀、腰酸乏力、形寒肢冷，舌淡苔白、脉虚。宜选用的中成药是
A. 启脾丸
B. 右归丸
C. 固本益肠片
D. 四神丸
E. 龟鹿二仙膏

正确答案：C。固本益肠片

解析：本题考查的是固本益肠片的主治。患慢性肠炎数年，症见腹痛绵绵、大便清稀或有黏液及黏液血便、食少腹胀、腰酸乏力、形寒肢冷，舌淡苔白、脉虚。宜选用的中成药是固本益肠片（C对）。固本益肠片：【主治】脾肾阳虚所致的泄泻，症见腹痛绵绵、大便清稀或有黏液及黏液血便、食少腹胀、腰酸乏力、形寒肢冷、舌淡苔白、脉虚；慢性肠炎见上述证候者。启脾丸（A错）：【主治】脾胃虚弱，消化不良，腹胀便溏。右归丸（B错）：【主治】肾阳不足，命门火衰，腰膝酸冷，精神不振，怯寒畏冷，阳痿遗精，大便溏薄，尿频而清。四神丸（D错）：【主治】肾阳不足所致的泄泻，症见肠鸣腹胀、五更泄泻、食少不化、久泻不止、面黄肢冷。龟鹿二仙膏（E错）：【主治】肾虚精亏所致的腰膝酸软、遗精、阳痿。